交感神经对胃肠运动与分泌的作用是
A. 胃肠运动增强，分泌抑制
B. 胃肠运动及分泌均抑制
C. 胃肠运动及分泌均增强
D. 胃肠运动抑制，分泌增强
E. 胃肠内的括约肌抑制

正确答案：B。胃肠运动及分泌均抑制